依据《处方管理办法》，为门（急诊）癌症疼痛患者开具的麻醉药品注射剂每张处方不得超过
A. 三日常用量
B. 四日常用量
C. 二日常用量
D. 五日常用量
E. 七日常用量

正确答案：A。三日常用量

解析：为门（急）诊癌症疼痛患者和中、重度慢性疼痛患者开具的麻醉药品、第一类精神药品注射剂，每张处方不得超过3日常用（A对）。控缓释制剂，每张处方不得超过15日常用量；其他剂型，每张处方不得超过7日常用量。为住院患者开具的麻醉药品和第一类精神药品处方应当逐日开具，每张处方为1日常用量。